第2、3、4鳃弓形成了一个大的位于中线的突起，此突起最后形成
A. 舌体
B. 舌根
C. 界沟
D. 口咽膜
E. 奇结节

正确答案：B。舌根

解析：舌根来自于第2、3、4鳃弓形成的一个大的位于中线的突起。这个突起随着舌的发育形成舌根。掌握“腭部与舌的发育”知识点。